以下关于宫颈癌的叙述错误的是
A. 宫颈癌是最常见的妇科恶性肿瘤
B. 患者的年龄分布呈双峰状，25～29岁和60～64岁
C. 宫颈癌的发病与性生活紊乱、过早性生活、分娩年龄小、多产、经济状况低下、种族等因素有关
D. 通过性交而传染的某些病毒可能与宫颈癌的发病有一定关系
E. 多数宫颈癌起源于宫颈移行带

正确答案：B。患者的年龄分布呈双峰状，25～29岁和60～64岁